多用于牙周夹板，放置在两个以上的余留牙上，且无游离臂端的属于哪种锻丝卡环形式
A. 连续卡环
B. 尖牙卡环
C. 双臂卡环
D. 三臂卡环
E. 圈形卡环以上为锻丝卡环的各种类型

正确答案：A。连续卡环

解析：连续卡环：多用于牙周夹板，放置在两个以上的余留牙上。连续卡环无游离臂端，借卡环臂中间弹性较好的部分进入倒凹区固位。掌握“局部义齿固位体”知识点。